以下上颌前牙的髓腔形态的叙述中，正确的是
A. 上颌前牙的髓腔唇舌剖面观呈梭形
B. 上颌前牙的髓腔近远中剖面观呈三角形
C. 上颌切牙根颈横剖面的髓腔呈圆三角形，唇侧比舌侧宽，与牙根外形基本一致
D. 上颌尖牙髓腔为椭圆形，位于牙根的中央，唇舌径大于近远中径
E. 以上均正确

正确答案：E。以上均正确

解析：本题考查恒前牙、恒前磨牙的髓腔形态及应用解剖。上颌前牙的髓腔唇舌剖面观呈梭形（A对），髓腔近远中剖面观呈三角形（B对）。切牙根颈横剖面的髓腔呈圆三角形，唇侧比舌侧宽，与牙根外形基本一致（C对），位居剖面的中央略偏唇侧。尖牙髓腔为椭圆形，位于牙根的中央，唇舌径大于近远中径（D对）。综上，以上上颌前牙的髓腔形态的叙述均正确（E对，为本题正确答案）。